男，67岁。头痛、呕吐数天。4个月前有头部摔伤史。头颅CT示右额颞顶新月形中等密度影。该患者治疗首选
A. 对症支持治疗
B. 脱水利尿药降低颅压
C. 手术切除治疗
D. 给予止痛药治疗
E. 钻孔引流术

正确答案：E。钻孔引流术

解析：老年男性患者，头痛、呕吐数天（颅内压增高的表现），有头部外伤史，头颅CT示右额颞顶新月形中等密度（慢性硬膜下血肿的典型表现），结合患者病史、临床表现和影像学表现，应诊断为右额颞顶慢性硬膜下血肿。该患者已有明显的颅内高压症状，应首选钻孔引流术（E对），从根本上消除引起颅内高压的原因。对症支持治疗（A错）、脱水利尿药降低颅压（B错）和给予止痛药物治疗（D错）均为一般辅助治疗，单独应用并不能根治。开颅手术血肿切除术（C错）主要用于治疗急性硬膜外血肿或急性硬膜下血肿。